网膜囊的后壁是
A. 小网膜、胃后壁的腹膜
B. 大网膜的前层、胃后壁的腹膜
C. 小网膜、胃结肠韧带
D. 横结肠及其系膜以及覆盖在胰，左肾，左肾上腺等处的腹膜
E. 无

正确答案：D。横结肠及其系膜以及覆盖在胰，左肾，左肾上腺等处的腹膜

解析：小网膜、胃后壁的腹膜和胃结肠韧带为网膜囊的前壁（ABC错），横结肠及其系膜以及覆盖在胰、左肾、左肾上腺等处的腹膜为网膜囊的后壁（D对）。